药品商品名称
A. 受商标法保护
B. 是某一类药品的专用商品名称
C. 在药品注册后成为药品通用名称
D. 应符合SFDA的规定并经其批准方可使用
E. 不得作为药品商标

正确答案：D。应符合SFDA的规定并经其批准方可使用